女，30岁，近2个月中度发热，全身肌痛，四肢关节肿痛，口腔溃疡。尿常规示红细胞（+）/高倍视野，蛋白（++）。免疫学检查最可能出现的抗体是
A. 抗核抗体
B. 抗Jo-1抗体
C. 抗Scl-70抗体
D. 类风湿因子
E. 抗中性粒细胞胞浆抗体

正确答案：A。抗核抗体

解析：育龄女性患者（系统性红斑狼疮好发人群），出现中度发热、全身肌痛、四肢关节肿痛、口腔溃疡（系统性红斑狼疮典型表现），尿常规提示血尿、蛋白尿（系统性红斑狼疮肾损害），考虑患者最可能的诊断为系统性红斑狼疮。几乎所有系统性红斑狼疮患者均可出现的自身抗体为抗核抗体（A对）。抗Jo-1抗体（B错）为多发性肌炎特异性抗体（P848）。抗Scl-70抗体（C错）常见于系统硬化病（P853）。类风湿性因子（D错）常见于类风湿性关节炎，系统性红斑狼疮患者亦可出现，但少见。抗中性粒细胞胞浆抗体（E错）常见于系统性血管炎。